管理角膜的感觉
A. 展神经
B. 视神经
C. 眼神经
D. 滑车神经
E. 动眼神经

正确答案：C。眼神经

解析：眼神经（C对）的分支有额神经、泪腺神经、鼻睫神经，其中鼻睫神经的分支有滑车下神经和睫状神经节，睫状神经节分布控制角膜、睫状体、虹膜等。